晶样体多出现在以下哪种腺体导管中
A. 腮腺
B. 唇腺
C. 舌下腺
D. 舌腺
E. 下颌下腺

正确答案：A。腮腺

解析：晶样体多出现在腮腺导管中，呈针状，指状或板状，既可引起周围组织的炎症，又可形成结石中心的核。掌握“唾液腺组织学特点”知识点。